病理性焦虑和恐惧症状的主要区别在于有无
A. 运动不安
B. 失眠
C. 惊恐发作
D. 自主神经功能紊乱
E. 明确的指向对象

正确答案：E。明确的指向对象

解析：恐惧症和广泛性焦虑障碍都以焦虑为核心症状，但恐惧症的焦虑由特定的对象或处境引起，呈境遇性和发作性，而焦虑障碍的焦虑常没有明确的对象，常持续存在。病理性焦虑和恐惧症的主要区别在于：病理性焦虑没有明确对象，恐惧症有特定的对象（E对）。